患者腹大胀满不舒，早宽暮急，面色苍黄，嗜睡，语无伦次，逐渐昏迷，舌苔灰腻，脉弦细而滑。治疗应首选
A. 温胆汤
B. 菖蒲郁金汤
C. 白金丸
D. 苏合香丸
E. 涤痰汤

正确答案：D。苏合香丸

解析：题中患者以腹大胀满不舒为主症，故诊断为臌胀。脾肾阳气不运，水寒之气不行，故腹大胀满不舒，早宽暮急；面色苍黄为脾肾阳虚的表现；痰浊壅盛，蒙蔽心窍，则嗜睡，语无伦次，逐渐昏迷，舌苔灰腻，脉弦细而滑。故辩证为痰湿蒙闭心包，治宜芳香温开透窍，方选苏合香丸（D对）。温胆汤功能理气化痰，和胃利胆为治疗痰火扰神证的选方（A错）。菖蒲郁金汤功能清营透热祛痰，主伏邪风温，辛凉发汗后，表邪虽解，暂时热退身凉，而胸腹之热不除，继则灼热自汗，烦躁不寐，神识时昏时清，夜多谵语，脉数舌绛，四肢厥而脉陷，症情较轻者（B错）。白金丸功能化顽痰，袪恶血，为治疗狂证痰热瘀结证见不饥不食者（C错）。涤痰汤功能涤痰开窍为治疗痫病痰火扰神证选方（E错）。